邪热内盛，深伏于里，阳气被遏，不能外达，手足厥冷，属于
A. 阳损及阴
B. 阳盛格阴
C. 阴盛格阳
D. 阴损及阳
E. 阴阳脱失

正确答案：B。阳盛格阴

解析：阳盛格阴指阳气偏盛至极，深伏于里，热盛于内，排斥阴气于外的一种病理变化。热盛于内是疾病的本质，但由于排斥阴气在外，可在原有壮热、面红、气粗、烦躁、舌红、脉数大有力等热盛于内表现的基础上，又出现四肢厥冷、脉沉伏等假寒之象（B对）。阳损及阴（A错）指由于阳气虚损，无阳则阴无以生，从而在阳虚的基础上又导致了阴虚，形成以阳虚为主的阴阳两虚的病理变化。阴盛格阳（C错）指阴气偏盛至极，壅闭于里，寒盛于内，逼迫阳气浮越于外的一种病理变化。寒盛于内是疾病的本质，由于排斥阳气于外，可在原有面色苍白、四肢逆冷、精神萎靡、畏寒蜷卧、脉微欲绝等寒盛于内的基础上，又出现面红、烦热、口渴、脉大无根等假热之象。阴损及阳（D错）指阴气亏损，累及阳气生化不足，或阳气无所依附而耗散，从而在阴虚的基础上又出现了阳虚，进而形成了以阴虚为主的阴阳两虚的病理状态。阴阳脱失（E错）指机体的阴气或阳气突然大量地亡失，导致生命垂危的一种病理变化。